植皮术后游离皮瓣最容易发生血管危象的时间是
A. 12小时内
B. 24小时内
C. 36小时内
D. 48小时内
E. 72小时内

正确答案：E。72小时内

解析：植皮术后72小时内是游离皮瓣最容易发生血管危象的时候。掌握“口腔颌面部后天畸形概论”知识点。